颌面部外伤导致窒息最主要的诊断指标是
A. 三凹体征
B. 呼吸急促
C. 鼻翼扇动
D. 血压下降
E. 口唇发绀

正确答案：A。三凹体征

解析：窒息的前驱症状为患者烦躁不安、出汗、口唇发绀、鼻翼扇动和呼吸困难、严重者在呼吸时出现“三凹”（锁骨上窝、胸骨上窝及肋间隙明显凹陷）体征；随之发生脉弱、脉速、血压下降及瞳孔散大等危象以至死亡。掌握“口腔颌面部创伤急救”知识点。